患者近年来反复发作全身强直，阵挛，昏睡。本次发作强直-阵挛持续时间达2小时，伴高热，汗出。应首先考虑的是
A. 癫痫合并低钙血症
B. 癫痫持续状态
C. 急性脑出血
D. 急性脑栓塞
E. 癔病性发作

正确答案：B。癫痫持续状态

解析：患者近年来反复发作全身强直，阵挛，昏睡。本次发作强直-阵挛持续时间达2小时，伴高热，汗出，可以诊断为癫痫持续状态（B对），是神经内科的常见急症。病人始终处于昏迷状态，随反复发作而间歇期越来越短，体温升高，昏迷加深。如不及时采取紧急措施终止发作，病人将因衰竭而死亡。癫痫合并低钙血症（A错）不会出现强直-阵挛持续时间达2小时。急性脑出血（C错）的主要特点为头痛、呕吐、意识障碍、偏瘫、偏身感觉障碍和偏盲。急性脑栓塞（D错）的特点为轻度意识障碍，脑水肿，颅内压增高，昏迷及抽搐发作。癔病性发作（E错）不伴有昏迷等表现。